越鞠丸的组成药物中不含
A. 香附
B. 白术
C. 神曲
D. 川芎
E. 梔子

正确答案：B。白术

解析：本题考查方剂的组成，越鞠丸组成有香附（A错）、川芎（D错）、苍术、栀子（E错）、神曲（C错）。没有白术”（B对）。